属于中危器械的是
A. 腊刀
B. 牙锤
C. 拔牙钳
D. 去冠器
E. 技工钳

正确答案：D。去冠器

解析：本题考查口腔器械分类、危险级别。属于中危器械的是去冠器（D对）。1.高度危险口腔器械：穿透软组织、接触骨、进入或接触血液或其他无菌组织的口腔器械。2.中度危险口腔器械：与完整黏膜相接触，而不进入人体无菌组织、器官和血流，也不接触破损皮肤、破损黏膜的口腔器械。3.低度危险口腔器械：不接患者口腔或间接接患者口腔，参与口腔诊疗服务，虽有微生物污染但在一般情况下无害，只有受到一定量的病原微生物污染时才造成危害的口腔器械。腊刀（A错）、牙锤（B错）技工钳（E错）属于低危器械。拔牙钳（C错）属于高危器械。